以下不属于其他表面消毒的是
A. 病历夹
B. 门把手
C. 医院墙体
D. 水龙头
E. 门窗

正确答案：C。医院墙体

解析：其他表面消毒：包括病历夹、门把手、水龙头、门窗、洗手池、卫生间、便池等物体表面，这些地方容易受到污染。通常情况下，每天用洁净水擦抹刷洗处理，保持清洁。掌握“患者、医务人员及环境的防护”知识点。